现时寿命表的期望寿命
A. 不受人口年龄别构成的影响
B. 不受人口性别构成的影响
C. 不受人群数量的影响
D. 是人群各年龄别死亡率的综合反映

正确答案：A、D。不受人口年龄别构成的影响；是人群各年龄别死亡率的综合反映

解析：本题考查期望寿命。现时寿命表的期望寿命是各年龄别死亡率的综合反映（D对），它不受人口年龄别构成的影响（A对BC错）。